干酪样坏死的本质是
A. 纤维蛋白样坏死
B. 脂肪坏死
C. 干性坏疽
D. 液化性坏死
E. 彻底的凝固性坏死

正确答案：E。彻底的凝固性坏死

解析：干酪样坏死是指，当凝固性坏死灶中脂质含量较多时，坏死区呈黄色，状似干酪，其特点为不见坏死部位原有组织结构的残影，甚至不见核碎屑，因此本质上是彻底的凝固性坏死（E对）。纤维蛋白样坏死（A错）即纤维素样坏死（P20），是常见于结缔组织和小血管壁的一种坏死，镜下可见病变部位形成颗粒状或小条块状无结构物质，染色性质似纤维素。脂肪坏死（P21）（B错）属于液化性坏死，有特征性灰白色钙皂形成。干性坏疽（P21）（C错）是坏疽的一种分类，常继发于肢端组织缺血性坏死，多表现为凝固性坏死。液化性坏死（P20）（D错）是指因坏死组织中可凝固的蛋白质少，或坏死细胞自身及浸润的中性粒细胞等释放大量水解酶，或组织富含水分和磷脂，导致细胞组织坏死后易发生溶解液化。